染色体畸变属于
A. 生物性致病因素
B. 先天性致病因索
C. 理化性致病因素
D. 免疫性致病因素
E. 遗传性致病因素

正确答案：E。遗传性致病因素

解析：遗传因素指染色体畸变和基因变异引起的疾病，所以染色体畸变属于遗传性致病因素（E对）。